某医师开展心血管疾病的危险因素调查不属于环境因素的危险因素是
A. 微量元素
B. 病毒感染
C. 社会心理因素
D. 寒冷
E. 年龄

正确答案：E。年龄

解析：环境危险因素包括水、土壤、空气和食物，而年龄不在其中。掌握“环境卫生与职业卫生”知识点。